骨折线从梨状孔下方，牙槽突上方两侧水平方向延伸至上颌翼突缝称为
A. LeFortⅠ型骨折
B. LeFortⅡ型骨折
C. LeFortⅢ型骨折
D. 横断形、分离性骨折
E. 纵行骨折

正确答案：A。LeFortⅠ型骨折

解析：LeFortⅠ型骨折：又称上颌骨低位骨折或水平骨折。骨折线从梨状孔水平、牙槽突上方向两侧水平延伸至上颌翼突缝。掌握“牙槽突骨折、颌骨骨折”知识点。